衡量某疾病的原因归因于暴露某危险因素程度的最好指标是
A. 归因危险度百分比
B. 归因危险度
C. 人群归因危险度
D. 人群归因危险度百分比
E. 相对危险度

正确答案：A。归因危险度百分比

解析：衡量某疾病的原因归因于暴露某危险因素程度的最好指标是归因危险度百分比（A对），它反映某因素的暴露者中，单纯由于该因素引起发病的危险占整个病因的比例。归因危险度（B错）（P058）表示暴露人群与非暴露人群比较，所增加的发病率（死亡率）。也就是说减少这个暴露因素可减少这个数量的发病率。人群归因危险度（C错）（P058）表示总人群因暴露与某因素而导致的某病发病率（死亡率）。人群归因危险度百分比（D错）（P058）是指总人群因暴露于某因素所致的某病发病或死亡占总人群该病全部发病或死亡的百分比。相对危险度（E错）是衡量某病和某暴露因素间联系强度最有用的指标。